某女，35岁。因月经不调就诊，诊断为月经先期，辨证属肝经郁热证，宜选用的中成药是
A. 乌鸡白凤丸
B. 丹栀逍遥丸
C. 益母丸
D. 妇科调经片
E. 艾附暖宫丸

正确答案：B。丹栀逍遥丸

解析：本题考查的是月经先期的辨证论治。月因月经不调就诊，诊断为月经先期，辨证属肝经郁热证，宜选用的中成药是丹栀逍遥丸（B对）。月经先期：月经周期提前7天以上，甚至10余日一行，连续两个周期以上者，称为“月经先期”，既往亦称“经期超前”“经行先期”“经早”“经水不及期”等。月经先期属于以周期异常为主的月经病，常与月经过多并见，严重者可发展为崩漏，应及时进行治疗。西医学功能失调性子宫出血和盆腔炎等出现月经提前为主要表现时，可参考此内容辨证论治。（一）脾气虚证：【中成药应用】常用中成药有人参归脾丸（大蜜丸）、当归丸。（二）肾气虚证：【中成药应用】常用中成药有女金丹丸。（三）肝郁血热证：【中成药应用】常用中成药有丹栀逍遥丸。乌鸡白凤丸（A错）为崩漏气血两虚证的中成药应用。崩漏气血两虚证：【中成药应用】常用中成药有定坤丹、乌鸡白凤丸、养血饮口服液。益母丸（C错）为月经后期气滞证的中成药应用。月经后期气滞证：【中成药应用】常用中成药有益母丸、得生丸、调经丸、调经活血片。妇科调经片（D错）为月经先后无定期肝郁证的中成药应用。月经先后无定期肝郁证：【中成药应用】常用中成药有妇科调经片、香附丸、妇科十味片。艾附暖宫丸（E错）：【功能】理气养血，暖宫调经。【主治】血虚气滞、下焦虚寒所致的月经不调、痛经，症见行经后错、经量少、有血块、小腹疼痛、经行小腹冷痛喜热、腰膝酸痛。